一个集体的人群中短时间内某病的发病数明显增多
A. 季节性
B. 周期性
C. 短期波动
D. 遗传性
E. 长期变异

正确答案：C。短期波动

解析：短期波动：指在一个地区或一个集体的人群中，短时间内某病的发病数明显增多的现象。掌握“流行病学资料与疾病分布”知识点。